胃的幽门至中间沟的部分为
A. 角切迹
B. 贲门切迹
C. 幽门管
D. 胃道
E. 胃穹隆

正确答案：C。幽门管

解析：幽门管(C对)为胃的幽门与中间沟之间的部分，角切迹(A错)为胃小弯最低点弯度转折处，贲门切迹(B错)为食管末端左缘与胃底形成的锐角，胃道(D错)为胃小弯内部纵行粘膜皱襞间沟，胃穹窿(E错)为胃底。